非附着菌斑中优势细菌为
A. 变形链球菌
B. 放线共生放线杆菌
C. 革兰阳性菌
D. 革兰阴性能动菌
E. 金黄色葡萄球菌

正确答案：D。革兰阴性能动菌

解析：本题考查非附着菌斑的优势细菌。牙菌斑生物膜包括龈上菌斑和龈下菌斑，龈下菌斑又可分为附着性龈下菌斑和非附着性龈下菌斑。龈缘以下位于附着性龈下菌斑的表面或直接与龈沟上皮、袋内上皮接触的龈下菌斑称为非附着性龈下菌斑生物膜，为结构松散的菌群，优势细菌为革兰阴性能动菌（D对），如牙龈卟啉单胞菌等。变形链球菌（A错）是口腔中的主要致龋菌。放线共生放线杆菌（B错）是口腔中常见的细菌之一。革兰阳性菌（C错）是龈上菌斑生物膜的优势菌。金黄色葡萄球菌（E错）是口腔组织感染的优势菌。